接触化合物的途径不同，其毒性大小的顺序是
A. 静脉注射＞经呼吸道
B. 静脉注射＞腹腔注射
C. 腹腔注射＞经口
D. 以上都是

正确答案：D。以上都是

解析：本题考查毒性大小的顺序。接触化合物的途径不同，其毒性大小的顺序是：静脉注射＞经呼吸道＞腹腔注射＞肌内注射＞皮下注射＞皮内注射＞经口＞经皮（D对ABC错）。